皮瓣移植后多有温度下降的现象时，可用白炽灯在（）外照射加温
A. 5cm
B. 10cm
C. 20cm
D. 30cm
E. 50cm

正确答案：D。30cm

解析：皮瓣移植后多有温度下降的现象，可以用白炽灯距30cm以外行照射加温，以保持正常的血液循环。掌握“皮瓣移植”知识点。